显性致死试验的遗传学终点为
A. 基因突变
B. 染色体畸变
C. DNA完整性改变
D. 细胞坏死
E. 细胞恶性转化

正确答案：B。染色体畸变